别嘌醇用于治疗
A. 惊厥
B. 帕金森病
C. 抑郁症
D. 痛风
E. 记忆障碍

正确答案：D。痛风

解析：本题考查痛风治疗药。别嘌醇适用于尿酸生成过多或不适合使用排尿酸药物者治疗痛风（D对）。别嘌醇不可用于治疗惊厥（A错），帕金森病（B错），抑郁症（C错），记忆障碍（E错）。